下列各项中，不属于卫生法基本原则的是
A. 卫生保护原则
B. 预防为主原则
C. 公平原则
D. 初级卫生保健原则
E. 患者自主原则

正确答案：D。初级卫生保健原则

解析：本题考查卫生法的基本原则。初级卫生保健原则（D错，为本题的正确答案）不属于卫生法基本原则。卫生法的基本原则包括卫生保护原则（A对）、预防为主原则（B对）、公平原则（C对）、患者自主原则（E对）、保护社会健康原则。